男性，35岁。有胃溃疡病史，今日早饭后，突然上腹痛，拒按。查体：腹壁呈板状僵硬，可能为
A. 阑尾炎
B. 胰腺炎
C. 胆囊炎
D. 溃疡穿孔
E. 肠梗阻

正确答案：D。溃疡穿孔

解析：青年男性患者，有胃溃疡病史，突发上腹痛，查体见腹壁呈板状僵硬（腹膜刺激症状），结合患者病史和体查，最可能的诊断为溃疡穿孔（D对）。阑尾炎（A错）起病多较缓慢，典型表现为转移性右下腹疼痛，腹部体征较局限。胰腺炎（P457）（B错）多表现为左上腹疼痛，可向左肩及左腰背部放射，肌紧张程度较轻。胆囊炎（P443）（C错）多见于女性，病人多有胆囊结石病史，主要表现为右上腹绞痛或持续性疼痛伴阵发性加剧，疼痛可放射到右肩、肩甲和背部，Murphy征阳性。肠梗阻（P358）（E错）主要表现为腹痛、呕吐、腹胀及停止自肛门排气排便，查体可触及腹部包块。